关联可以在不同人群、不同地区和不同时间重复观察到，这是
A. 关联的一致性
B. 剂量-反应关系
C. 暴露终止效应
D. 关联的特异性
E. 关联的可重复性

正确答案：E。关联的可重复性